在体外培养或小鼠体内接种这种杂交瘤细胞可生产单克隆抗体为
A. 鼠疫抗体
B. 鼠源抗体
C. 鼠瘟抗体
D. 鼠症抗体
E. 鼠病抗体

正确答案：B。鼠源抗体

解析：体外培养或小鼠体内接种这种杂交瘤细胞可生产单克隆抗体。这种单克隆抗体为鼠源抗体。掌握“各类球蛋白的特性和功能”知识点。